可见典型的皮脂腺结构或含有脂肪的导管上皮细胞团的为下列哪种腺体
A. 唇腺
B. 舌腭腺
C. 腮腺
D. 下颌下腺
E. 舌下腺

正确答案：C。腮腺

解析：在腮腺的闰管与分泌管交界处，可见典型的皮脂腺结构或含有脂肪的导管上皮细胞团，在大导管上皮细胞间亦见有少数含黏液的杯状细胞，此细胞因腺体慢性炎症而增多。掌握“唾液腺组织学特点”知识点。